属于肝药酶CYP3A4抑制剂的是
A. 西咪替丁
B. 地红霉素
C. 西酞普兰
D. 奥卡西平
E. 度洛西汀

正确答案：A。西咪替丁

解析：本题考查肝药酶的抑制剂。西咪替丁（A对）是肝药酶CYP1A2、肝药酶CYP2C9、肝药酶CYP2D6、肝药酶CYP3A4抑制剂。地红霉素（B错）不是肝药酶抑制剂。西酞普兰（C错）是肝药酶CYP2D6抑制剂。奥卡西平（D错）是肝药酶CYP2C19抑制剂。度洛西汀（E错）是肝药酶CYP2D6抑制剂。